下列哪项不是因果关联的判定标准
A. 样本大小
B. 时间顺序
C. 联系的合理性
D. 剂量-反应关系

正确答案：A。样本大小

解析：本题考查希尔病因推断的标准。因果关联的判断标准包括时间顺序（B对），关联强度，剂量-反应关系（D对），结果的一致性，试验证据，生物学合理性（C对），生物学一致性，特异性，相似性。样本大小（A错，为本题正确答案）不是因果关联的判定标准。